严重胸腹联合损伤后，必须首先处理的是
A. 呼吸骤停
B. 闭合性液气胸
C. 急性弥漫性腹膜炎
D. 粉碎性胸腰椎骨折
E. 轻度血压下降

正确答案：A。呼吸骤停

解析：严重胸腹联合损伤患者往往病情较重，胸部损伤后病人多有呼吸急促、呼吸困难或发绀；腹部损伤多有内出血或急性腹膜刺激症状。对于已有呼吸骤停（A对）患者，由于胸腔内残余的氧气很快消耗殆尽，导致血氧含量降低，大脑对缺氧耐受能力差，缺氧4～6分钟即可导致不可逆性损伤，因此需首先处理。闭合性液气胸（B错）、急性弥漫性腹膜炎（C错）、粉碎性胸腰椎骨折（D错）、轻度血压下降（E错）短时间内均不会威胁生命，应当在处理致命伤后按照病情的轻重处理。